便秘患者长期使用可引起结肠黑变病的药物是
A. 硫酸镁
B. 聚乙二醇4000
C. 乳果糖
D. 番泻叶
E. 比沙可啶

正确答案：D。番泻叶

解析：本题考查番泻叶的不良反应。长期服用番泻叶（D对）、芦荟、大黄等含蒽醌类泻药会发生结肠黑变病。硫酸镁（A错）为容积性泻药，停留于肠腔内使肠内容积的渗透压升高，反射性增加肠蠕动而导泻。聚乙二醇4000（B错）口服后不吸收，不分解，可结合水分子，有效增加肠道体液成分，引起水样腹泻。乳果糖（C错）在结肠内被消化道菌丛转化为低分子量有机酸，导致肠道内pH下降，通过渗透作用增加结肠内容量。比沙可啶（E错）通过刺激肠壁的感受神经末梢，引起肠反射性蠕动增强而排出柔软并成形的软便。